下列影响疾病的人群分布特征的因素中哪一项与疾病之间的关联相对来说最强
A. 年龄
B. 性别
C. 职业
D. 民族或种族

正确答案：A。年龄

解析：本题考查年龄因素在疾病中的影响。年龄（A对BCD错）是人群最主要的人口学特征之一，几乎所有疾病的发生及发展均与年龄有相当密切的关系。研究疾病的年龄分布，有助于深入认识疾病的分布规律，探索流行因素，为病因研究和疾病的预防与控制提供基本线索。